不耐酸、碱，溶于有机溶剂，可在120℃、30分钟热压灭菌的是
A. 醋酸纤维素膜
B. 硝酸纤维素膜
C. 聚酰胺膜
D. 聚四氟乙烯膜
E. 聚偏氟乙烯膜

正确答案：B。硝酸纤维素膜